患儿，5个月。面色时青时红，频作惊惕，大便色青，日行3次。其治法是
A. 缓肝理脾
B. 补益心脾
C. 重镇潜阳
D. 镇惊安神
E. 平肝熄风

正确答案：D。镇惊安神

解析：急惊风主症为痰、热、惊、风，治疗应以清热、豁痰、镇惊、息风为基本法则，题中患儿元气未充，神气怯弱，易受惊吓，惊则气乱，恐则气下，致使面色时青时红，频作惊惕，大便色青，日行3次，治以镇惊安神（D对）。缓肝理脾适于脾虚肝旺的慢惊风，症见面色萎黄，嗜睡露睛，精神萎靡，继而脾不制肝而动风，出现抽搐反复发作（A错）。补益心脾适于心脾两虚的注意力缺陷多动症，症见神思涣散，多动而不暴躁，记忆力差，神疲乏力（B错）。重镇潜阳适于阴虚导致的肝阳上亢的病症，症见头痛眩晕、耳鸣耳聋、面红目赤、急躁易怒、肢体麻木等症（C错）。平肝熄风适于因肝风而引动的抽搐、抽风、战栗等症状，患儿症状较轻，无肝风内动之表现（E错）。